肾上端紧邻
A. 肝门
B. 十二指肠
C. 肾上腺
D. 胃底
E. 结肠

正确答案：C。肾上腺

解析：肾上腺（C对）紧邻肾的上端。肝（A错）与右肾前上部相邻，十二指肠（B错）与肾内侧缘相邻，胃底（D错）与左肾前上部相邻，结肠（E错）与下部相邻。